27岁初产妇，妊娠39周，规律宫缩6小时，枕左前位，估计胎儿体重2700g，胎心142次/分。阴道检查：宫口开大3cm，未破膜，S=+1，骨盆外测量未见异常。若此后宫缩逐渐减弱，产程已18小时，胎膜已破，宫口开大8cm，此时恰当处理应是
A. 静注地西泮加速产程进展
B. 静脉滴注缩宫素
C. 肌内注射缩宫素
D. 静脉注射麦角新碱
E. 立即行剖宫产术

正确答案：B。静脉滴注缩宫素

解析：青年初产妇，妊娠39周，规律宫缩6小时，宫口扩张3cm（第一产程潜伏期为宫口开始扩张至扩张3cm，需8小时），说明第一产程潜伏期顺利，胎儿体重2700g（正常出生体重儿：BM≥2500g并≤4000g），胎心142次/分（正常为110～160次/分），此时胎头已下降至坐骨棘平面以下1cm（S=＋1），说明头盆已衔接，骨盆外测量未见异常，故此时恰当处理应是等待自然分娩。但是进入活跃期已12小时（活跃期最大时限为8小时），应诊断为活跃期延长。宫口开大3cm后出现宫缩逐渐减弱，说明导致活跃期延长的原因为协调性子宫收缩乏力。且宫口扩张≥3cm、胎心良好、胎位正常、头盆相称，则应采取加强宫缩，正确的处理应是静脉滴注缩宫素（B对）。静脉推注地西泮（P189）（A错）用于镇静，不能加速产程进展。缩肌内注射缩宫素（P189）（C错）只能用于产后出血。麦角新碱可选择性兴奋子宫平滑肌，但剂量稍大即可引起子宫平滑肌强直收缩，妊娠后期子宫对其敏感性增强，因此不能用于催产和引产，故静脉注射麦角新碱（D错）只能用于产后子宫出血。该孕妇胎心良好、胎位正常、头盆相称、头盆已衔接、胎头已下降至坐骨棘平面以下1cm，能够经阴道分娩，不需立即行剖宫产术（E错）。